逍遥散、藿香正气散均源于
A. 《备急千金要方》
B. 《外科正宗》
C. 《温病条辨》
D. 《太平惠民和剂局方》
E. 《本草纲目》

正确答案：D。《太平惠民和剂局方》

解析：本题考查的是《太平惠民和剂局方》。逍遥散、藿香正气散均源于《太平惠民和剂局方》（D对）。《太平惠民和剂局方》：简称《和剂局方》《局方》，宋代太医局编。全书10卷。该书为宋代官府颁行，是我国第一部成药典，撷取了张仲景、孙思邈、钱乙、朱肱等名家良方，荟萃宋以前历代方剂之精华，名方出于是书者甚多，如二陈汤、平胃散、四君子汤、四物汤、十全大补汤、参苓白术散、紫雪丹、至宝丹、苏合香丸、牛黄清心丸、藿香正气散、香苏散、香薷散、逍遥散、参苏饮、人参败毒散、失笑散、八正散、川芎茶调散、附子理中丸、戊己丸、三拗汤、半硫丸、无比山药丸、人参养荣丸、真人养脏汤、苏子降气汤、香连丸、肥儿丸、来复丹、青娥丸等，皆为选药精良、配伍得宜、切于实用而卓有疗效的著名方剂。该书对后世影响颇大，其所载方剂至今在临床上多有应用。《备急千金要方》（A错）：简称《千金要方》，唐·孙思邈撰著。成书于唐永徽三年（公元652年）。全书30卷。孙氏首重医德，序例中著有“大医习业”“大医精诚”两篇专论。孙氏集唐以前方书之大成，使之流传后世，如犀角地黄汤、大小续命汤、独活寄生汤、苇茎汤、温胆汤、定志丸、磁珠丸、蛇床子散、半夏茯苓汤、盐汤探吐方、枕中丹等名方，仍为现代临床所常用。《外科正宗》（B错）为明代著作，书中载有透脓散、消风散、辛夷清肺饮等方剂。《温病条辨》（C错）为清代著作，书中载有银翘散、桑菊饮、桑杏汤、沙参麦冬汤、增液汤等方剂。《本草纲目》（E错）：简称《纲目》，明·李时珍著，成书于1578年。此书可谓中药学巨著，内容广博，收罗繁富。全书引据历代本草凡84家，古今医书目277种，另从经史子集各部著作中引录了大量有关的文献资料，参考文献共计800余种。书中共收载药物1892种，方剂11096首，附有药物图谱1109幅。问世后被全部或部分译成日、朝、英、法、意、俄等多种文字。